描述暴发疫情严重性的最佳指标
A. 死亡率
B. 续发人数
C. 发病人数
D. 罹患率
E. 患病人数

正确答案：D。罹患率

解析：描述暴发疫情严重性的最佳指标是罹患率（D对）。罹患率适用于小范围、短时间内疾病频率的测量。